厚朴组织中含
A. 油细胞
B. 油管
C. 油室
D. 黏液细胞
E. 油细胞与黏液细胞

正确答案：A。油细胞